烟、尘、雾中的烟指的是空气中直径小于（）的固体颗粒
A. 10㎛
B. 1㎛
C. 0.1㎛
D. 0.01㎛

正确答案：C。0.1㎛

解析：本题考查烟的理化性质。悬浮于空气中的液体微滴称为雾，多由蒸气冷凝或液体喷洒而形成。悬浮于空气中直径小于0.1㎛（C对ABD错）的固体微粒称为烟。能较长时间悬浮在空气中，其粒子直径为0.1～10㎛的固体微粒则称为粉尘。生产中烟和粉尘可混合存在。飘浮在空气中的粉尘、烟和雾，统称为气溶胶。